女，42岁。经常于清晨或空腹后出现乏力、心慌、冷汗，重者神智不清，抽搐、昏迷。可于进食或口服、静点葡萄糖后缓解。发作时测血糖常低于2.5mmol/L。该病人最可能的诊断是
A. 胃泌素瘤
B. 胰岛素瘤
C. 心血管疾病
D. 脑血管疾病
E. 癫痫

正确答案：B。胰岛素瘤

解析：患者为中年女性。经常于清晨或空腹后出现乏力、心慌、冷汗，重者神智不清，抽搐、昏迷（提示可能为低血糖）。可于进食或口服、静点葡萄糖后缓解。发作时测血糖常低于2.5mmol／L（进一步确认为由低血糖引起的上述症状）。该病人最可能的诊断是胰岛素瘤。胰岛素瘤是功能性胰腺内分泌肿瘤中最为常见者，女性发病率高于男性，高发年龄为40～50岁。胰岛素瘤的首发症状是低血糖的表现，常表现为由低血糖引起的头痛、视物模糊、思维不连贯、健忘。此外，病人还可能发作癫痫、共济失调、言语及自助运动障碍，最为严重的表现是昏迷。喝糖水常可缓解症状。故该病人最可能的诊断是胰岛素瘤（B对）。胃泌素瘤（A错）主要表现为顽固性消化性溃疡和腹泻。溃疡最常见于十二指肠球部。约半数病人有腹泻，与胃酸高分泌有关（P467）。心血管疾病（C错）和脑血管疾病（D错）都可能出现乏力、心慌、冷汗，甚至神智不清，抽搐、昏迷的症状，但是口服、静点葡萄糖后不能缓解。癫痫（E错）发作时也可能出现抽搐、昏迷的症状，但是口服、静点葡萄糖后亦不能缓解。